IARC根据对人的致癌物危险将致癌物分类，正确的描述是
A. 1类：对人致癌
B. 1类：对人很可能致癌
C. 2A类：对人可能致癌
D. 2B类：对人很可能致癌
E. 3类：对人很可能不致癌

正确答案：A。1类：对人致癌

解析：本题考查致癌物的分类。IARC根据对人的致癌物危险将致癌物分成4类：1.Ⅰ类：对人致癌（A对BCDE错），118种；2.ⅡA类：对人很可能致癌，79种；3.ⅡB类：对人可能致癌，290种；4.Ⅲ类：对人的致癌性尚无法分类，即可疑对人致癌，501种；5.Ⅳ类：对人很可能不致癌，仅1种。